评价一个致病因子的公共卫生意义，宜选用
A. 绝对危险度
B. RR
C. PAR
D. AR
E. PAR％

正确答案：D。AR

解析：本题考查归因危险度的意义。归因危险度（AR）（D对ABCE错）是指暴露人群与非暴露人群比较，所增加的疾病发生数量，如果暴露因素消除，就可减少这个数量的疾病发生，归因危险度具有疾病预防和公共卫生学上的意义。